一些做临床科研工作的医生未征求病人的同意，只与病人的主管大夫打声招呼，便以某种理由或在正常检查时顺便多取些血液或骨髓穿刺液等。从医学伦理学上分析上述做法，下列各项中正确的是
A. 若告知，患者会产生不必要的心理负担，不利于原来疾病的治疗，所以不告知符合不伤害和有利原则
B. 若告知，病人多数不会同意，科研没法进行保障，不利于医学的发展，故不告知在道德上可得到辩护
C. 临床科研的医生动机是好的，若告知会产生不好的结果，所以案例中的做法无论是从动机还是结果考虑都是最佳的
D. 无论医生科研动机的好与坏，只要未经过患者的知情同意，都是不道德的
E. 病人有支持医学科学发展的义务，故医生有权利这样做

正确答案：D。无论医生科研动机的好与坏，只要未经过患者的知情同意，都是不道德的

解析：人体实验必须经过受试者知情同意，知情同意是人体实验进行的前提。凡是采取欺骗、强迫、经济诱惑等手段使受试者接受的人体实验，无论医生科研动机的好与坏，只要未经过患者的知情同意，都是不道德的（D对）或违反法律的行为。